关于感染过程中潜伏感染特点的叙述正确的是
A. 迅速引起显性感染
B. 一旦免疫功能下降可引起显性感染
C. 病原体侵入人体后，潜伏在各个部位
D. 每种感染性疾病均有潜伏性感染
E. 病原体不断排出体外

正确答案：B。一旦免疫功能下降可引起显性感染

解析：潜伏性感染又称潜在性感染。病原体侵入人体后，潜伏在某些部位（C错），由于机体免疫功能足以将病原体局限化而不引起显性感染（A错），但又不足以将病原体清除时，病原体便可长期潜伏起来，待机体免疫功能下降时，则可引起显性感染（B对）。潜伏性感染期间，病原体一般不排出体外（E错）。潜伏性感染并不是在每种传染病中都存在（D错），常见的潜伏性感染有单纯疱疹病毒、水痘病毒、疟原虫和结核杆菌等感染。